大隐静脉恒定地经过
A. 膝关节内后方
B. 小腿外侧面
C. 外踝前方
D. 内踝后方
E. 内、外踝连线中点

正确答案：A。膝关节内后方

解析：大隐静脉恒定地经过膝关节内后方（A对）、沿小腿内侧面（B错）、内踝前方（D错），至耻骨结节外下方3-4cm处穿阔筋膜的隐静脉裂孔，注入股静脉。